“牙本质多部分暴露，但尚未暴露继发牙本质和牙髓”可以诊断为
A. 轻度磨耗
B. 重度磨耗
C. 轻度磨损
D. 中度磨损
E. 重度磨损

正确答案：D。中度磨损

解析：磨损的诊断：①轻度磨损：釉质丧失，牙本质部分暴露；②中度磨损：牙本质多部分暴露，但尚未暴露继发牙本质和牙髓；③重度磨损：釉质完全丧失，继发牙本质暴露或牙髓暴露。掌握“磨损”知识点。